选择性IgA缺陷症是属于
A. B细胞缺陷病
B. T细胞缺陷病
C. T、B细胞联合免疫缺陷病
D. 吞噬细胞缺陷
E. 补体系统缺陷

正确答案：A。B细胞缺陷病